某女，53岁。症见四肢厥逆、恶寒踡卧、呕吐不渴、腹痛下利、神衰欲寐，舌苔白滑，脉象微细。医师处以四逆汤。处方组成：淡附片300g、干姜200g、炙甘草300g。制法：以上三味，淡附片、炙甘草加水煎煮二次，第一次2小时，第二次1.5小时，合并煎液，滤过。干姜用水蒸气蒸馏提取挥发油，挥发油和蒸馏后的水溶液备用；姜渣再加水煎煮1小时，煎液与上述水溶液合并，滤过，再与淡附片、炙甘草的煎液合并，浓缩至约400ml，放冷，加乙醇1200ml，搅匀，静置24小时，滤过，减压浓缩至适量，用适量水稀释，冷藏24小时，滤过，加单糖浆、苯甲酸钠与上述挥发油，加水至1000ml，搅匀，灌封，灭菌，即得。其质量应符合《中国药典》合剂项下有关的各项规定。处方中淡附片是由附子炮制而成，关于淡附片炮制方法的说法，正确的是
A. 由泥附子浸入食用胆巴的水溶液数日，煮至透心，水漂，切片，用调色液染至浓茶色，蒸后晒干而得
B. 由泥附子浸入食用胆巴的水溶液，加食盐浸泡，取出，切片，晒干而得
C. 由泥附子浸入食用胆巴的水溶液，煮至透心，剥去外皮，切片，蒸透晒干
D. 由净盐附子漂尽盐分，与甘草、黑豆加水共煮至透心，除去甘草、黑豆，切薄片，干燥而得
E. 取砂置锅内，加入附片拌炒至鼓起、变色，去砂，放凉而得

正确答案：D。由净盐附子漂尽盐分，与甘草、黑豆加水共煮至透心，除去甘草、黑豆，切薄片，干燥而得

解析：本题考查的是附子的炮制方法。处方中淡附片是由附子炮制而成，关于淡附片炮制方法的说法，正确的是由净盐附子漂尽盐分，与甘草、黑豆加水共煮至透心，除去甘草、黑豆，切薄片，干燥而得（D对）。附子：【炮制方法】处方用名有白附片、炮附片、淡附片。①盐附子：选个大、均匀的泥附子，洗净，浸入食用胆巴的水溶液中过夜，再加食盐，继续浸泡，每日取出晒晾，并逐渐延长晒晾时间，直至附子表面出现大量结晶盐粒（盐霜)，体质变硬。②黑顺片：取泥附子，按大小分别洗净，浸入食用胆巴的水溶液中数日，连同浸液煮至透心，捞出，水漂，纵切成厚约0.5cm的片，再用水浸漂，用调色液使附片染成浓茶色，取出，蒸至出现油面、光泽后，烘至半干，再晒干或继续烘干（A错）。③白附片：取大小均匀的泥附子，洗净，浸入食用胆巴的水溶液中数日，连同浸液煮至透心，捞出，剥去外皮，纵切成厚约0.3cm的片，用水浸漂，取出，蒸透，晒干（C错）。④炮附片：取砂置锅内，用武火炒热，加入附片，拌炒至鼓起并微变色，取出，筛去砂，放凉（E错）。⑤淡附片：取净盐附子，用清水浸漂，每日换水2～3次，至盐分漂尽，与甘草、黑豆加水共煮，至透心，切开后口尝无麻舌感时，取出，除去甘草、黑豆，切薄片，干燥。每100kg盐附子，用甘草5kg，黑豆10kg。